8个月小儿体重，按公式计算应为
A. 7.0kg
B. 7.5kg
C. 8.0kg
D. 8.5kg
E. 9.0kg

正确答案：D。8.5kg

解析：3～12月龄：体重（kg）=[年龄（月）+9]/2
1～6岁：体重（kg）=年龄（岁）×2+8
7～12岁：体重（kg）=[年龄（岁）×7-5]/2
12岁以后为青春发育阶段，受内分泌影响，体重增长较快（是体格增长的第二个高峰），且存在较大的个体差异，不再按上述公式计算。掌握“体格生长常用指标”知识点。